非索非那定为H₁受体阻断药，适用于减轻季节性过敏性鼻炎和慢性特发性荨麻疹引起的症状。下列关于非索非那定结构和临床使用的说法，错误的是
A. 为特非那定的体内活性代谢产物
B. 具有较大的心脏毒副作用
C. 分子中含有一个羧基
D. 不易通过血-脑屏障，因而几乎无镇静作用
E. 口服后吸收迅速

正确答案：B。具有较大的心脏毒副作用

解析：本题考查非索非那定的结构和临床使用。非索非那定具有比原型药物更强的抗组胺活性和更低的心脏毒性（B错，为本题正确答案）。非索非那定属于H₁受体拮抗剂，是一种抗过敏药，是特非那定羧基化（C对）体内活性代谢产物（A对），可以选择性地阻断组胺H₁受体，具有比较好的组胺作用。同时也没有抗五羟色胺、抗胆碱和抗肾上腺素的作用，所以引起的副作用相对较小，口服吸收之后能够较快地发挥作用（E对）。可用于治疗季节性过敏性鼻炎或者是荨麻疹引起的临床症状。非索非那定不易通过血-脑屏障，因而几乎无镇静作用（D对）。